氯丙嗪引起锥体外系反应是由于阻断
A. 结节-漏斗通路中的D2受体
B. 黑质-纹状体通路中的D2受体
C. 中脑-边缘系中的D2受体
D. 中脑-皮质通路中的D2受体
E. 中枢M-胆碱受体

正确答案：B。黑质-纹状体通路中的D2受体

解析：长期大量服用氯丙嗪出现的锥体外系反应是由于氯丙嗪拮抗了黑质-纹状体通路的D2样受体。使纹状体中的多巴胺功能减弱、乙酰胆碱的功能增强的而引起的，可减少药量、停药来减轻或消除，也可用抗胆碱药以缓解。掌握“氯丙嗪”知识点。